克林霉素的抗菌谱不包括
A. 立克次体
B. 放线杆菌
C. 脆弱拟杆菌
D. 金黄色葡萄球菌
E. 产气荚膜杆菌

正确答案：A。立克次体